血容量不足时中心静脉压往往低于多少(cmH20)
A. 14
B. 12
C. 10
D. 8
E. 5

正确答案：E。5

解析：中心静脉压可反映全身血容量与右心功能之间的关系。正常值为5～10cmH2O，当中心静脉压小于5cmH2O时，表示全身血容量不足。掌握“休克”知识点。